高血压高血脂患者，服用某药后，经检查发现肝功能异常，则该药物是
A. 辛伐他汀
B. 缬沙坦
C. 氨氯地平
D. 维生素E
E. 亚油酸

正确答案：A。辛伐他汀

解析：本题考查他汀类药物。引起肝功能异常的药物是辛伐他汀（A对）。辛伐他汀是他汀类的降血脂药物，用于控制血液中胆固醇的含量以及预防心血管疾病。缬沙坦（B错）是降血压药。氨氯地平（C错）为钙离子通道阻断剂,阻断钙离子通道,起到扩张血管的作用。维生素E（D错）是抗氧化剂。亚油酸（E错）是人和动物营养中必需的脂肪酸，可用于治疗血脂过高和动脉硬化。